男，78岁。因进行性气短2周就诊，无咳嗽发热胸痛。胸部X线片示左侧大量胸腔积液。血WBC8.9×10⁹/L，N0.72，Hb110g/L，ESR36mm/h。假设该患者胸部CT示左侧支气管通畅，左下肺直径2cm分叶状结节影，纵隔可见直径1～2cm的肿大淋巴结，该患者胸腔积液治疗最有效的措施为
A. 胸膜固定术
B. 手术治疗
C. 反复穿刺抽液
D. 全身化疗
E. 免疫治疗

正确答案：D。全身化疗

解析：老年男性患者，胸部X线片示左侧大量胸腔积液，血WBC8.9×10⁹/L（正常值为4～10×10⁹/L），N0.72（正常值为0.5～0.7），提示该患者为非感染性疾病，HB110g/L（稍低于正常男性120～160g/L），ESR36mm/h（高于男性正常值为0～20mm/h，提示有恶性肿瘤的可能），胸部CT示左侧支气管通畅，左下肺2cm分叶状结节影（提示可能为周围型肺癌），纵隔可见肿大淋巴结（提示肺癌有纵隔淋巴结转移），结合患者病史、临床表现、影像学检查和相关实验室检查，该患者最可能的诊断为周围型肺癌伴纵隔淋巴结转移，TNM分期为T1aN2M0（ⅢA期），故该患者胸腔积液多是由于肿瘤侵犯胸膜所致。对于肺癌所致恶性胸腔积液，病因治疗尤为重要，最有效的措施为全身化疗（D对）。胸膜固定术（A错）主要用于全身或局部治疗无效、需反复胸腔穿刺抽液的患者。该患者已有纵隔淋巴结转移，手术治疗（B错）可考虑在放化疗后进行。反复穿刺抽液（C错）只能短期内缓解患者的症状，无法从根本上解决引起胸腔积液的原因。免疫治疗（E错）可用于肺癌的辅助治疗，但对胸腔积液的治疗意义不大。